将体型分为长躯型、中躯型和短躯型所依据的指标是
A. 肺活量指数
B. 握力指数
C. BMI指数
D. 身高坐高指数
E. 身高体重指数

正确答案：D。身高坐高指数